按照无牙颌解剖特点，切牙乳突属于
A. 主承托区
B. 副承托区
C. 缓冲区
D. 后堤区
E. 边缘封闭区

正确答案：C。缓冲区

解析：本题考查无牙颌的解剖标志及功能分区。缓冲区（C对）：无牙颌的骨性隆突部位，如上颌隆突、颧突、上颌结节的颊侧、下颌隆突、下颌舌骨嵴以及牙槽嵴上的骨尖、骨棱等部位，表面被覆黏膜较薄，切牙乳突内有神经和血管。这些部位均不能承受咀嚼压力，全口义齿基托组织面在上述的相应部位应做缓冲处理，以免因压迫导致疼痛，或形成支点而影响义齿的稳定。